患者，女性，23岁。诉咀嚼无力。口腔检查；上下第一磨牙牙周袋6mm，松动Ⅰ°，菌斑指数和牙龈指数1，初步诊断为青少年牙周炎。本病的主要致病菌是
A. 伴放线放线杆菌
B. 中间普氏菌
C. 核梭杆菌
D. 牙龈卟啉单胞菌
E. 直肠弯曲菌

正确答案：A。伴放线放线杆菌

解析：本题考查局限型侵袭性牙周炎的致病菌。旧分类将侵袭性牙周炎，包含青少年牙周炎、快速进展性牙周炎和青春前期牙周炎，新分类分为局限型和广泛型。局限型侵袭性牙周炎，病变局限于第一磨牙和切牙，开始于青春期前后，牙周组织破坏程度与局部刺激的量不成正比，早期出现牙松动和移位，咀嚼无力，故诊断为侵袭性牙周炎，即旧分类的青少年牙周炎。国外大量的研究表明伴放线放线杆菌（A对）（现称伴放线聚集杆菌）是侵袭性牙周炎的主要致病菌。中间普氏菌是妊娠期龈瘤的优势菌（B错）。核梭杆菌和螺旋体感染可引起急性坏死溃疡型龈炎（C对）。牙龈卟啉单胞菌是引起牙周炎症的主要细菌（D错），侵袭性牙周炎是伴放线放线杆菌的特殊感染。